金黄色葡萄球菌肠毒素A～E属于
A. 外源性抗原
B. 外源性超抗原
C. 内源性抗原
D. 内源性超抗原
E. 病毒性超抗原

正确答案：B。外源性超抗原